农业生产的主要职业危害是
A. 有毒气体
B. 粉尘
C. 不良气象条件
D. 噪声
E. 电磁辐射

正确答案：C。不良气象条件